“前有狼，后有虎”，这种动机冲突是
A. 双趋冲突
B. 双避冲突
C. 趋避冲突
D. 双重趋避冲突
E. 双趋双避冲突

正确答案：B。双避冲突

解析：双避冲突：指两种目标都是个体力图避免的，但是个体回避一个威胁性目标的同时，必然面临另一个威胁性目标时表现出的心理冲突。所谓“后有追兵，前遇大河”正是说明这种处境。掌握“需要与动机”知识点。